高血压伴高钾血症禁用
A. 螺内酯
B. 氨氯地平
C. 氢氯噻嗪
D. 维拉帕米缓释剂
E. 美托洛尔

正确答案：A。螺内酯

解析：螺内酯（A错，为本题正确答案）属于保钾利尿剂，主要作用于肾远曲小管远端，通过拮抗醛固酮或直接抑制Na⁺-K⁺交换而具有保钾作用，因此高血压伴高钾血症禁用螺内酯。氢氯噻嗪（C对）为噻嗪类利尿剂，降压作用主要通过排钠，减少细胞外容量，降低外周血管阻力。在排尿的过程中，钾的排泄也增多，因此高血压伴高钾血症可以使用氢氯噻嗪，其能降低血压同时降低血钾。氨氯地平（B对）和维拉帕米缓释剂（D对）都属于钙通道阻滞剂，降压作用主要通过阻滞钙通道减少细胞外钙离子进入血管平滑肌细胞内，降低阻力血管的收缩反应。美托洛尔（E对）属于选择性β₁受体拮抗剂，可通过抑制中枢和周围RAAS，抑制心肌收缩力和减慢心率发挥降压作用。后三种药物对血钾浓度均无明显影响，并非高血压伴高钾血症禁用药物。